具有促进排便作用药物是
A. 地芬诺酯
B. 硫酸镁
C. 酚酞
D. 乳酶生
E. 乳果糖

正确答案：B、C、E。硫酸镁；酚酞；乳果糖

解析：本题考查促进排便作用药物。促进排便作用药物有硫酸镁（B对）、酚酞（C对）、乳果糖（E对）。泻药包括容积性泻药、渗透性泻药、刺激性泻药、润滑性泻药、膨胀性泻药、肠道清洗剂及胃肠动力药。硫酸镁为容积性泻药；乳果糖是渗透性泻药；酚酞属于刺激性泻药；地芬诺酯（A错）是人工合成的止泻药；乳酶生（D错）抑制腐败菌的生长繁殖，防止发酵，减少产气，因而有促进消化和止泻作用。